卡环体的作用
A. 起固位作用，防止义齿牙合向移动
B. 起稳定作用，防止义齿侧向移动
C. 起支持作用，防止义齿龈向移动
D. 起固位和稳定作用，防止义齿牙合向和侧向移动
E. 起稳定和支持作用，防止义齿侧向和龈向移动

正确答案：E。起稳定和支持作用，防止义齿侧向和龈向移动

解析：本题考查卡环体的作用。卡环体的作用为起稳定和支持作用，防止义齿侧向和龈向移动（E对）。卡环体又称卡环肩，为连接卡环臂、支托、和小连接体的坚硬部分，环抱于基牙的非倒凹区，从邻面包过颊舌轴面角，可阻止义齿龈向和侧向移动，起稳定和支持义齿的作用，同时支撑卡环臂。起固位作用，防止义齿（牙合）向移动（A错）的部件有直接固位体、间接固位体、卡环尖。起稳定作用，防止义齿侧向移动（B错）的是卡环臂的起始部分，较坚硬，通常放置在非倒凹区。起支持作用，防止义齿龈向移动的是部件是（牙合）支托（C错）。直接固位体是防止义齿（牙合）向脱位，起主要固位作用的固位部件，间接固位体主要是增强义齿的稳定，防止游离端义齿（牙合）向脱位，对抗侧向力，防止义齿旋转和翘动，因而固位体是起固位和稳定作用，防止义齿（牙合）向和侧向移动的作用（D错）。